56岁，男性患者，自述间歇无痛性肉眼血尿3个月来门诊就诊。查体：一般状态好，轻度贫血貌，双肾未触及，膀胱区叩诊清音。该病例首选的简便检查方法是
A. B型超声
B. CT
C. MRI
D. 腹部平片
E. 肾图

正确答案：A。B型超声

解析：中年男性患者，间歇无痛性肉眼血尿、轻度贫血貌（提示可能有泌尿系肿瘤），双肾未触及，结合患者病史和体查，该病例临床诊断首先考虑泌尿系肿瘤，以膀胱肿瘤可能性大（膀胱肿瘤是泌尿系统最常见的肿瘤，多发生于中老年男性）。故该病例首选的简便检查方法是B型超声（A对），B超简便易行，能发现直径0.5cm以上的膀胱肿瘤，可作为病人的最初筛选。CT（B错）和MRI（C错）多用于浸润性膀胱癌癌，可以发现肿瘤浸润膀胱壁深度、淋巴结及内脏转移的情况，由于价格昂贵，一般不作为首选检查。腹部平片（D错）主要用于上尿路结石的诊断，对膀胱癌诊断价值不大。肾图（E错）主要用于测定肾小管分泌功能和显示上尿路有无梗阻。